关于药物吸收的说法，正确的是
A. 在十二指肠由载体转运吸收的药物，胃排空缓慢有利于其口服吸收
B. 食物可减少药物的吸收，药物均不能与食物同服
C. 药物的亲脂性会影响药物的吸收，油/水分配系数小的药物吸收较好
D. 固体药物粒子越大，溶出越快，吸收越好
E. 临床上大多数脂溶性小分子药物的吸收过程是主动转运

正确答案：A。在十二指肠由载体转运吸收的药物，胃排空缓慢有利于其口服吸收

解析：本题考查药物的吸收。在十二指肠由载体转运吸收的药物，胃排空缓慢有利于其口服吸收（A对）；食物可以使某些药物的吸收增多，也可以没有影响（B错）；脂溶性太强的药物因为难以从类脂膜中游离入水性体液中而导致难以被吸收（C错）；药物粒子越大，越不容易溶出，吸收越慢（D错）；脂质小分子药物容易穿过细胞膜，转运方式大多为被动转运（E错）。